某男，70岁。患缺铁性贫血，医师嘱其服用硫酸亚铁片，一次0.3g,一日3次，饭后服。近日因失眠多梦，心悸，健忘，头晕耳鸣，到药店购买中药。不宜选用的中成药是
A. 安神补心丸
B. 脑力静糖浆
C. 宁神补心片
D. 滋肾宁神丸
E. 天王补心丸

正确答案：E。天王补心丸

解析：本题考查含汞类中药与西药联合应用。不宜选用的中成药是天王补心丸（E对）。含汞的中药及其制剂，不能与具有还原性的西药如硫酸亚铁、亚硝酸异戊酯同服，同服后能使Hg²⁺还原成Hg⁺，毒性增强。含汞类：朱砂、升汞、轻粉、红粉，以及中成药安宫牛黄丸、牛黄清心丸、朱砂安神丸、天王补心丸。不建议将宁神补心片与安神补心丸（A错）同时使用，因属重复用药。合理用药指导：（1）孕妇慎用眠安宁口服液。热证、实证、阴虚火旺证不寐者均不适用北芪五加片。脑力静糖浆（B错）中含维生素B₁、维生素B₂、维生素B₆、甘油磷酸钠（50%）等西药成分，应避免重复联合用药。（2）不建议将脑力静糖浆与甘麦大枣汤同时使用，因属重复用药。合理用药指导：滋肾宁神丸（D错）宜餐后服，外感发热及痰火实热者忌服，过敏体质者慎用。合理用药指导：（1）孕妇慎用天王补心丸、朱砂安神丸；因含有朱砂，天王补心丸、朱砂安神丸均不宜长期服用。孕妇、哺乳期妇女禁用宁神补心片（C错）。肝肾功能不全者禁用天王补心丸。脾肾阳虚、脾胃虚寒、大便稀溏及感冒发热者不宜服用宁神补心片。宁神补心片宜饭前服用，文献报道其可能导致皮肤瘙痒，所以在首次使用时应监测患者皮肤的变化。（2）不建议将天王补心丸与朱砂安神丸同时使用，因其皆含有朱砂，易出现有毒药物超量，属于联合用药不适宜。